采用背俞穴治疗骨蒸、潮热，应首选
A. 肝俞
B. 肺俞
C. 脾俞
D. 三焦俞
E. 心俞

正确答案：B。肺俞

解析：肺俞为肺之背俞穴，主治肺疾的同时，也可治疗阴虚病证如：骨蒸潮热、盗汗等（B对）。肝俞主治：①胁痛、黄疽等肝胆病证；②目赤、目视不明、夜盲、迎风流泪等目疾；③癫狂痫；④脊背痛（A错）。脾俞主治：①腹胀、纳呆、呕吐、腹泻、痢疾、便血、水肿等脾胃肠腑病证；②背痛（B错）。三焦俞主治：①肠鸣、腹胀、呕吐、腹泻、痢疾等脾胃肠腑病证；②小便不利、水肿等三焦气化不利病证；③腰背强痛（D错）。心俞主治：①心痛、惊悸、失眠、健忘、癫痫等心与神志病变；②咳嗽，吐血；③盗汗，遗精（E错）。记忆：俞穴治疗相应脏腑病+其它